关于肺血管的叙述，下列哪项是错误的
A. 有功能性和营养性血管之分
B. 肺动脉的分支与支气管树伴行
C. 支气管动脉为肺组织提供营养
D. 肺泡壁毛细血管为有孔型
E. 肺静脉管腔较支气管静脉大

正确答案：D。肺泡壁毛细血管为有孔型

解析：肺血管有功能性和营养性血管之分（A对）。肺动脉的分支与支气管树伴行（B对）。支气管动脉为肺组织提供营养（C对）。肺静脉管腔较支气管静脉大（E对，故D错为本题正确答案）。